在备洞过程中下例哪项不是减少疼痛的方法
A. 选择适宜的器械
B. 间断磨除法操作
C. 药物处理
D. 局部麻醉
E. 冷水冷却

正确答案：C。药物处理

解析：本题考查无痛制洞法。在备洞过程中药物处理（C错，为本题正确答案）不是减少疼痛的方法。药物处理，如单氯甘氨酸溶液，可使软化牙本质的胶原解体而易被去除，此法操作时间长，对慢性龋去腐效果较差，仍需用器械磨除。选择适宜的器械（A对），高速、间断磨除龋坏组织（B对），可减少对牙髓刺激，疼痛时间短，且程度轻。局部麻醉（D对）可以减少疼痛，且效果较好。冷水冷却（E对）可减少切割牙体组织时产生的热对牙髓的刺激。